生地黄的主要归经是
A. 肺、胃；心
B. 肺、脾、肾
C. 心、脾、肾
D. 心、肝、肾
E. 心、肝、脾

正确答案：D。心、肝、肾

解析：该题考查生地黄的性味归经。生地黄味甘、苦，性寒；入心、肝、肾经；具有清热凉血，养阴生津的作用（D对ABCE错）。